女职工的劳动范围不包括
A. 矿山井下作业
B. 体力劳动强度分级标准中规定的第四级体力劳动强度的作业
C. 每小时负重6次以上、每次负重超过10公斤的作业
D. 间断负重超过25公斤的作业
E. 每次负重超过25公斤的作业

正确答案：C。每小时负重6次以上、每次负重超过10公斤的作业

解析：本题考查女职工禁忌从事的劳动范围。女职工禁忌从事的劳动范围包括：矿山井下作业（A对）；体力劳动强度分级标准中规定的第四级体力劳动强度的作业（B对）；每小时负重6次以上、每次负重超过20公斤的作业（C错，为本题正确答案），或者间断负重每次负重超过25公斤的作业（DE对）。